女性，25岁。既往无精神病史，听闻其母急性心肌梗死去世后，患者不认识家人，反复念叨：不可能，你们骗我。此病人最可能的诊断是
A. 急性应激障碍
B. 创伤后应激障碍
C. 癔症
D. 病理性激情发作
E. 躁狂状态

正确答案：A。急性应激障碍

解析：该病患女性，既往无精神病史，因其母急性心肌梗死去世（严重精神刺激），患者不认识家人，反复念叨：不可能，你们骗我（强烈恐惧体验的精神运动性兴奋），最可能的诊断是急性应激障碍（A对）。创伤后应激障碍（PTSD）（P162）是以创伤性事件反复体验（患者在创伤性事件后，频频出现内容非常清晰的、与创伤事件明确相关的梦境）为主要症状，本例无此症状，故不考虑（Ｂ错）。癔症（分离（转换）障碍）可从患者的性格特点，症状丰富多变，在轻微不愉快的生活事件（与本例严重精神刺激不符）作用下反复发作，且发作具有明显的表演性、夸张性、做作性、躯体转换症状，本例无此症状，故不考虑（Ｃ错）。躁狂状态患者有典型的“三高”表现，即情感高涨（患者自我感觉良好，主观体验特别愉快）、思维奔逸、活动增多症状，与本例不符（Ｅ错）。